复合树脂的分层充填技术的叙述错误的是
A. 包括水平逐层填充和斜分层填充技术
B. 水平逐层填充适用于前牙唇面充填
C. 斜分层填充技术产生的聚合收缩最小
D. 充填时第一层树脂的厚度应在大于2mm
E. 斜分层填充技术是后牙窝洞充填的首选

正确答案：D。充填时第一层树脂的厚度应在大于2mm

解析：分层填充包括水平逐层填充和斜分层填充技术。水平逐层填充适用于前牙唇面充填和后牙窝洞髓壁的首层充填，斜分层填充技术产生的聚合收缩最小，是后牙窝洞充填的首选技术。充填时复合树脂的厚度对光照固化有明显影响。第一层树脂的厚度应在1mm内，以后每层树脂的厚度不要超过2mm。掌握“牙体充填材料之复合树脂”知识点。